甲状舌管囊肿最常见的好发部位是颈中线的
A. 舌根部
B. 舌骨下部
C. 舌骨上、下部
D. 舌骨上部
E. 胸骨切迹上

正确答案：C。舌骨上、下部

解析：甲状舌管囊肿多见于1～10岁的儿童，亦可见于成年人。可发生于颈正中线，自舌盲孔至胸骨切迹间的任何部位，但以舌骨上下部为最常见。掌握“甲状舌管囊肿及鳃裂囊肿”知识点。